急性心梗第3周出现发热和心包摩擦音，血沉30mm/h，血白细胞6.1×10⁹/L，中性粒细胞55%，可能是
A. 急性心梗的反应性心包炎
B. 心脏破裂
C. 急性心梗后综合征
D. 伴发病毒性心包炎
E. 室壁瘤

正确答案：C。急性心梗后综合征

解析：患者急性心梗第3周出现发热和心包摩擦音（急性心包炎特征性体征），血沉30mm/h（正常范围0～20mm/h，稍增快），可能是急性心梗后综合征（C对）。急性心梗的反应性心包炎（A错）一般发生在心梗1～4天内，系梗死区域心肌表面心包并发纤维素性炎症所致，可表现为早期一过性的心包摩擦音。心脏破裂（P240）（B错）常发生在心梗后1周内，游离壁破裂常引起急性心脏压塞而猝死，室间隔破裂时可在胸骨左缘第3～4肋间闻及响亮的收缩期杂音，常伴有震颤。伴发病毒性心包炎（D错）时一般有前驱病毒感染史，查血可见淋巴细胞增多。室壁瘤（P240）（E错）主要表现为心脏左界扩大，搏动范围较广，可有收缩期杂音。